小建中合剂既能温中补虚，又能
A. 散寒止痛
B. 泻火止痛
C. 活血止痛
D. 行气止痛
E. 缓急止痛

正确答案：E。缓急止痛

解析：本题考查的是小建中合剂的功能。小建中合剂既能温中补虚，又能缓急止痛（E对）。小建中合剂：【功能】温中补虚，缓急止痛。小活络丸：【功能】祛风散寒，化痰除湿，活血止痛（AC错）。黄连上清丸：【功能】散风清热，泻火止痛（B错）。血府逐瘀口服液：【功能】活血祛瘀，行气止痛（D错）。